在影响行为的各因素中，对行为具有激发作用的因素是
A. 生物因素
B. 学习因素
C. 先天因素
D. 环境因素
E. 后天因素

正确答案：D。环境因素